接种百白破三联疫苗适宜的时间是生后
A. 3个月，4个月，5个月
B. 2个月，3个月，4个月
C. 1个月，2个月，3个月
D. 出生时，1个月，2个月
E. 4个月，5个月，6个月

正确答案：A。3个月，4个月，5个月

解析：我国卫生部规定的儿童计划免疫程序百白破混合制剂于生后3个月、4个月、5个月接种（A对）。